女，19岁打工妹。干咳3月伴不规则发热，体温波动在37.8～38.5℃，无咯血及关节肌肉痛，先后多次静脉注射“头孢霉素”仍未见效，现停经50天。查体：消瘦，双颈部可触及成串小淋巴结，活动，无压痛，右上肺可闻及少量湿啰音。胸片示：右上肺大片密度不均阴影，有小空洞形成。该患者最可能的诊断是
A. 细菌性肺炎
B. 支原体肺炎
C. 过敏性肺炎
D. 干酪性肺炎
E. 肺脓肿

正确答案：D。干酪性肺炎

解析：患者为青年女性，慢性起病，干咳伴不规则发热，消瘦，闭经，先后多次静脉注射“头孢霉素”仍未见效（头孢菌素类抗生素对肺结核无效），根据其临床表现和体征，应考虑诊断为肺结核。右上肺可闻及少量湿啰音，胸片示右上肺大片密度不均阴影，有小空洞形成，符合干酪性肺炎的表现及影像学特点，应诊断为干酪性肺炎（D对）。细菌性肺炎（P46）（A错）通常急骤起病，以高热、寒战、咳嗽、胸痛为特征，抗生素治疗有效。支原体肺炎（P49）（B错）潜伏期2～3周，起病较缓慢，咳嗽多为阵发性刺激性呛咳，咳少量粘液，一般无明显肺部体征，无空洞形成。肺脓肿（P58）（E错）临床特征为高热、咳嗽和咳大量脓臭痰，胸部X线片显示有一个或多发的含气液平的空洞，且抗生素治疗有效。